有机磷农药抑制胆碱酯酶（ChE）活性的主要机制是农药结构中
A. 亲质子的磷酰基与ChE的酯解部位结合
B. 带正电荷部分与ChE负矩部位结合
C. 带正电荷部分与ChE的酯解部位结合
D. 带正电荷部分与ChE的酯解部位结合，而亲电子的磷酰基与ChE负矩部位结合
E. 带正电荷部分与ChE负矩部位结合，而亲电子的磷酰基与ChE的酯解部位结合

正确答案：E。带正电荷部分与ChE负矩部位结合，而亲电子的磷酰基与ChE的酯解部位结合